患者，女，38岁。类风湿性关节炎多年。现午后发热，盗汗，口干咽燥，手足心热，关节肿胀疼痛，小便赤涩，大便秘结，舌红少苔，脉细数。其中医治法是
A. 清热利湿，祛风通络
B. 养阴清热，祛风通络
C. 祛风散寒，清热化湿
D. 活血化瘀，祛痰通络
E. 益肝肾，补气血，祛风湿，通经络

正确答案：B。养阴清热，祛风通络

解析：患者阴虚阳亢，故见午后发热，盗汗，手足心热；阴虚不能濡养故见口干咽燥；邪热壅于关节，气血壅滞不通，故见关节肿胀疼痛；热盛津伤故见小便赤涩，大便秘结；舌红少苔，脉细数，为阴虚内热的表现，治疗应养阴清热，祛风通络（B对）。清热利湿，祛风通络（A错）治疗类风湿性关节炎湿热痹阻证。祛风散寒，清热化湿（C错）用于治疗寒热错杂证。活血化瘀，祛痰通络（D错）用于治疗痰瘀互结证。益肝肾，补气血，祛风湿，通经络（E错）用于治疗肝肾亏虚证。